气闭属于
A. 元气耗损
B. 气的生成障碍
C. 气的升降失常
D. 气的出入失常
E. 气的运行障碍

正确答案：D。气的出入失常

解析：本题考察气的失常中气机失调的类型及形成机制。气闭的产生是由情志刺激，或外邪、痰浊等闭塞气机，使气不得外出而闭塞清窍所致，属于气的出入失常表现。气滞属于气的运行障碍；气逆、气陷属于气的升降失常；气脱属于气的出入失常表现（D对）。